类风湿关节炎不常累及的关节是
A. 肘关节
B. 近端指间关节
C. 远端指间关节
D. 腕关节
E. 掌指关节

正确答案：C。远端指间关节

解析：类风湿关节炎（P807）（RA）是以侵蚀性、对称性多关节炎为主要表现的慢性、全身性自身免疫性疾病。关节痛往往是最早的症状，常累及的关节是腕（D对）、掌指（E对）、近端指间关节（B对）、肘（A对）等关节。骨关节炎常累及远端指间关节（C错，为本题正确答案）。